猪苓饮片的特征有
A. 不规则形的厚片
B. 周边灰黑色至黑色或黑褐色，凹凸不平
C. 切面细腻，光滑
D. 质硬
E. 味苦、微涩

正确答案：A、B。不规则形的厚片；周边灰黑色至黑色或黑褐色，凹凸不平